某男，59岁。胁下积块，固定不移，胀痛拒按；舌边瘀斑，苔薄，脉弦。诊断为积聚（肝硬化），证属气滞血阻，可选用的中成药有
A. 和络舒肝胶囊
B. 慢肝养阴胶囊
C. 化癥回生片
D. 肝脾康胶囊
E. 中华肝灵胶囊

正确答案：D、E。肝脾康胶囊；中华肝灵胶囊

解析：本题考查的是积聚的辨证论治。某男，59岁。胁下积块，固定不移，胀痛拒按；舌边瘀斑，苔薄，脉弦。诊断为积聚（肝硬化），证属气滞血阻，可选用的中成药有肝脾康胶囊（D对）、中华肝灵胶囊（E对）。积聚，又称“癥瘕”，是腹内结块，或痛或胀的疾病。（一）肝气郁结证：【中成药应用】常用中成药有逍遥丸、木香顺气丸、宽胸舒气化滞丸。（二）气滞血阻证：【中成药应用】常用中成药有中华肝灵胶囊、肝脾康胶囊、阿魏化痞膏。（三）瘀血内结证：【中成药应用】常用中成药有鳖甲煎丸、化癥回生片（C错）。（四）正虚邪结证：【中成药应用】常用中成药有和络疏肝胶囊（A错）、慢肝养阴胶囊（B错）。